与病例对照研究相比，队列研究的优点是
A. 更适合采取双盲法
B. 对研究对象进行了前瞻性的随访观察，因此无需矫正混杂因素
C. 更适合用卡方检验进行统计分折
D. 可以获得RR和AR
E. 适用于暴露常见而疾病罕见的情况

正确答案：D。可以获得RR和AR

解析：本题考查队列研究的最大优点。队列研究的最大优点在于可以直接计算出研究对象的结局的发生率，因而也就能够直接计算出RR和AR（D对ABCE错），从而可直接评价暴露的效应。